可以通过血胎屏障的抗体是
A. IgA
B. IgM
C. IgE
D. IgD
E. IgG

正确答案：E。IgG

解析：免疫球蛋白是介导体液免疫的重要效应分子，是B细胞接受抗原刺激后增值分化为浆细胞所产生的糖蛋白，主要分为IgM、IgA、IgD、IgE、IgG。其中，IgG（E对）的分子量最小，是唯一可以通过血胎屏障的抗体，在新生儿抗感染免疫中起重要作用。